牙支持式义齿
A. 主要由天然牙来承担（牙合）力
B. 多用于缺牙数目多，基牙健康者
C. 尤其适用于游离缺失的牙列缺损
D. 基托尽量大，以分散（牙合）力
E. 以上都不对

正确答案：A。主要由天然牙来承担（牙合）力

解析：本题考查局部义齿类型，肯氏分类及模型观测。牙支持式指缺隙两端均有余留天然牙，两端基牙均设置（牙合）支托，义齿所承受的（牙合）力主要由天然牙承担（A对）。适用于缺牙少、基牙稳固的病例，其修复效果较好。